治疗阴虚发热，应首选
A. 知柏地黄丸
B. 黄连阿胶汤
C. 生脉散
D. 犀角散
E. 清骨散

正确答案：E。清骨散

解析：清骨散加减可以滋阴清热，用于治疗内伤发热病的阴虚发热证（E对）。知柏地黄丸（A错）功用可滋阴降火，用于治疗阴虚火旺证。黄连阿胶汤（B错）可滋阴降火，交通心肾，用于治疗心肾不交的失眠。生脉散（C错）可益气养阴，敛汗生脉，用于治疗气阴两伤证。犀角散（D错）的功效为镇惊安神，可用于治疗小儿惊热，睡卧不安，筋脉抽掣。